下列哪种药物不宜与氨基苷类抗生素合用
A. 氨苯蝶啶
B. 乙酰唑胺
C. 阿米洛利
D. 布美他尼
E. 螺内酯

正确答案：D。布美他尼

解析：本题考查氨基糖苷类抗生素的配伍禁忌。下列药物中布美他尼（D错，为本题正确答案）不宜与氨基苷类抗生素合用。布美他尼具有耳毒性，与氨基糖苷类抗生素合用会加重耳毒性，故不宜一起使用。氨苯蝶啶（A对）、乙酰唑胺（B对）、阿米洛利（C对）、螺内酯（D对）无此使用禁忌。